下面哪个因素与白色念珠菌病的毒力无关
A. 胞质的组成
B. 疏水性
C. 黏附力
D. 侵袭酶
E. 表面抗体

正确答案：A。胞质的组成

解析：白色念珠菌的毒力主要在于侵袭力，其中黏附力和细胞外酶作用较肯定，而菌丝形成、抗吞噬作用等也可能增强其侵袭力。毒力大小与念珠菌对宿主黏膜及树脂塑料表面的黏附力、疏水性、芽管形成的能力、菌落的转化现象、产生蛋白酶和磷酸酶这两种水解酶的能力有关。掌握“口腔念珠菌病”知识点。